外渗性黏液囊肿其上皮成分是
A. 假复层上皮
B. 双层柱状上皮
C. 纤毛柱状上皮
D. 立方状上皮
E. 没有衬里上皮

正确答案：E。没有衬里上皮

解析：外渗性黏液囊肿唾液腺导管破裂，黏液外溢进入结缔组织内，黏液池被炎性肉芽组织和结缔组织包绕或局限，没有衬里上皮。掌握“黏液囊肿”知识点。